在下述指标中，使居民心脑血管疾病发病率降低的是
A. 经济发达国家膳食模式
B. 日本膳食模式
C. 东方膳食结构模式
D. 地中海膳食模式
E. 我国膳食模式

正确答案：D。地中海膳食模式